下列关于小儿用药特点的描述，错误的是
A. 婴幼儿鼻饲给药是不安全的
B. 皮下注射给药不适于新生儿
C. 早产儿皮肤薄不宜肌内注射
D. 婴幼儿静脉给药速度不要过快
E. 婴幼儿使用透皮吸收药物容易中毒

正确答案：A。婴幼儿鼻饲给药是不安全的

解析：本题考查新生儿用药。下列关于小儿用药特点的描述，错误的是婴幼儿鼻饲给药是不安全的（A错，为本题正确答案）。口服给药是最方便、最安全、最经济的给药途径，但影响因素较多，剂量不如注射给药准确，特别是吞咽能力差的婴幼儿受到一定限制。幼儿用糖浆、水剂、冲剂等较合适，年长儿可用片剂或丸剂，服药时要注意避免牛奶、果汁等食物的影响；小婴儿喂药时最好将其抱起或使头略抬高，以免呛咳时将药吐出。病情需要时可采用鼻饲给药。注射给药比口服给药起效快，但对小儿刺激大（B对）。临床上肌内注射部位多选择在臀大肌外上方，但注射次数过多可能造成臀部肌肉损害，需加以注意，且不得用于儿童（C对）。婴幼儿的液体容量小，输液速度不能过快（D对）。婴幼儿角质层薄，且相对表面积大，透皮吸收容易导致中毒（E对）。